分为深浅两叶，其中有面神经穿过的腺体为
A. 颊腺
B. 舌腺
C. 腭腺
D. 腮腺
E. 唇腺

正确答案：D。腮腺

解析：腮腺分为深浅两叶，其间有面神经穿过。掌握“唾液腺组织学特点”知识点。